通过选择性抑制5-HT再摄取，增加突触间隙5-HT浓度，从而增强5-HT能神经功能而发挥抗抑郁作用的药物是
A. 舍曲林
B. 阿米替林
C. 吗氯贝胺
D. 度洛西汀
E. 曲唑酮

正确答案：A。舍曲林

解析：本题考查舍曲林。通过选择性抑制5-HT再摄取，增加突触间隙5-HT浓度，从而增强5-HT能神经功能而发挥抗抑郁作用的药物是舍曲林（A对）。选择性5-HT再摄取抑制剂（SSRI）包括氟西汀、帕罗西汀、舍曲林、西酞普兰等。阿米替林（B错）为三环类抗抑郁药。吗氯贝胺（C错）为单胺氧化酶抑制剂。度洛西汀（D错）为5-HT和去甲肾上腺素（NA）再摄取抑制剂。曲唑酮（E错）为5-HT受体阻断剂/再摄取抑制剂。